女，65岁，右膝关节内侧严重疼痛，下蹲和下楼困难，步行距离500米。查体：右膝关节明显内翻畸形，伸展受限，关节活动度（ROM）：100°-20°-0°，负重位双膝关节X线片显示右膝内侧间隙明显狭窄，关节周边骨质增生，髌骨关节软骨磨损，关节面硬化，髌骨上下极骨赘生物形成。最适合的治疗方案是
A. 人工膝关节置换术
B. 关节镜清理术
C. 关节腔药物注射
D. 关节融合术
E. 口服非甾体抗炎药

正确答案：A。人工膝关节置换术

解析：老年女性患者，右膝关节内侧严重疼痛，下蹲和下楼困难，步行距离500米。查体：右膝关节明显内翻畸形，伸展受限，负重位双膝关节X线片显示右膝内侧间隙明显狭窄，关节周边骨质增生，髌骨关节软骨磨损，关节面硬化，髌骨上下极骨赘生物形成。综合患者的症状、体征和辅助检查，初步诊断为膝关节炎晚期，最适合的治疗方案是人工膝关节置换术（A对）。患者已出现膝内翻畸形和持续性疼痛的晚期表现，不再适用关节镜清理术（B错）、关节融合术（D错）。关节腔药物注射（C错）、口服非甾体抗炎药（E错）为药物治疗，适用于轻中度膝关节炎。